不宜行可摘义齿修复的是
A. 咽炎
B. 肝炎
C. 癫痫
D. 偏头痛
E. 牙周病

正确答案：C。癫痫

解析：本题考查可摘局部义齿的禁忌证。不宜行可摘义齿修复的是癫痫（C错，为本题正确答案）。可摘局部义齿的适用范围虽广，但也有临床注意事项，如：1.因精神疾病生活不能自理者如痴呆症、癫痫、精神病等患者，对可摘局部义齿不便摘戴、保管、清洁，甚至有误吞义齿危险的患者，不宜采用。2.对义齿材料过敏或对义齿异物感明显又无法克服者，不宜采用。3.严重的牙体、牙周或黏膜病变未得到有效治疗控制者，不宜采用。咽炎（A对）、肝炎（B对）、偏头痛（D对）、牙周病（E对）可行可摘义齿修复。